下列关于换药的注意事项中，描述错误的一项是
A. 应用棉球清洁暴露创面时是“蘸”而不是“揩”
B. 持镊应在中1/3处
C. 使用双手持镊，保持一“脏”一“净”
D. 对特异性感染创口，其换药用过的敷料更不可随便弃置，要集中焚烧
E. 每换一人后必须重新洗手，以防交叉感染

正确答案：B。持镊应在中1/3处

解析：持镊应在上1/3处，并勿使镊碰及非换药区，应掌握并使用双手持镊，保持一“脏”一“净”，即一镊接触创面，一镊接触药碗和消毒敷料。掌握“口外创口处理”知识点。